出生4~5个月后的婴儿需开始补充
A. 钙
B. 铁
C. 锌
D. 维生素E
E. 维生素B₁

正确答案：B。铁